解热镇痛药解热作用主要的机制是
A. 抑制中枢PG合成
B. 抑制外周PG合成
C. 抑制中枢PG降解
D. 抑制外周PG降解
E. 增加中枢PG释放

正确答案：A。抑制中枢PG合成

解析：在正常人体体温调节中枢位于下丘脑，通过调节体温调定点，控制产热和散热过程，维持体温正常。人体发热时，细菌的内毒素引起巨噬细胞释放多种细胞因子，其促进下丘脑合成PGE₂（PG系列），通过cAMP触发下丘脑体温调节中枢使体温调定点上调，使产热增加，散热减少，导致发热。解热镇痛药促进调定点复原而继而产生解热作用，即通过抑制下丘脑环氧化酶，阻断PGE₂合成，使体温调节中枢的体温调定点恢复正常（A对）。注：解热镇痛药只能降低发热者的体温，但不能降至正常体温之下，而且不能影响正常人的体温。注意与氯丙嗪对体温的影响的区别，氯丙嗪通过抑制下丘脑体温调节中枢而发挥解热作用，故对正常人的体温有影响。